食管癌的X线表现不包括
A. 管壁僵硬
B. 黏膜皱襞增粗
C. 黏膜呈串珠样改变
D. 黏膜皱襞断裂
E. 充盈缺损或龛影

正确答案：C。黏膜呈串珠样改变